为了了解被检者的思维品质，检查者使用了填词测验，这种测验方法属于
A. 投射法
B. 问卷法
C. 作业法
D. 操作法
E. 以上都不是

正确答案：A。投射法

解析：投射法：测验材料无严谨的结构，如一些意义不明的图像、一片模糊的墨迹或一句不完整的句子。要求受试者根据自己的理解随意作出回答，借以诱导出受试者的经验、情绪或内心冲突。投射法多用于测量人格，如洛夏墨迹测验、TAT等，也有用于异常思维的发现，如自由联想测验、填词测验等。掌握“心理测验分类及其应用与一般原则”知识点。